自身输血的作用主要是指
A. 容量血管收缩，回心血量增加
B. 抗利尿激素增多，水重吸收增加
C. 醛固酮增多，钠水重吸收增加
D. 组织液回流增多
E. 动－静脉吻合支开放，回心血量增加

正确答案：A。容量血管收缩，回心血量增加

解析：容量血管收缩，可减少血管床容量，回心血量增加（A对）。 这种代偿变化起到了自身输血的作用，有利于动脉血压的维持，是休克时增加回心血量和循环血量的“第一道防线”。抗利尿激素增多，水重吸收增加（B错）、醛固酮增多，钠水重吸收增加（C错）、组织液回流增多（D错）和动－静脉吻合支开放，回心血量增加（E错）具有一定代偿意，但不是自身输血的主要作用。